男性30岁，半年来反复出现口腔及舌部白斑，涂片及培养均发现白色念珠菌，既往体健，有吸毒史，体检体温不高，血WBC3.8×10⁹/L，为了查找真菌反复感染的原因，下列各项检查中最有帮助的是
A. 检查血清免疫球蛋白水平
B. 骨髓穿刺检查造血情况
C. 查血糖
D. 抗HIV
E. 检查血清补体C3水平

正确答案：D。抗HIV